在汇入门静脉的血流中，来自脾的血液约占
A. 0.20
B. 0.15
C. 0.1
D. 0.05
E. 0.25

正确答案：E。0.25

解析：门静脉主干由肠系膜上、下静脉和脾静脉汇合而成，约25％的血液来自脾（E对）。